腹部闭合性损伤病人，腹部X线平片发现腹膜后积气，最可能的损伤部位是
A. 横结肠
B. 乙状结肠
C. 直肠上端
D. 十二指肠球部
E. 十二指肠水平部

正确答案：E。十二指肠水平部

解析：病人腹部X线平片发现腹膜后积气，提示为腹膜外位空腔脏器破裂。腹膜外位器官指仅有一面被腹膜覆盖的器官，常见的腹膜外位空腔脏器有十二指肠降部、水平部、直肠中、下段等。综上，病人最可能损伤的部位是十二指肠水平部（E对）。横结肠（A错）、乙状结肠（B错）和十二指肠球部（D错）均为腹膜内位器官（表面几乎完全被腹膜所覆盖的器官），直肠上段（C错）为腹膜间位器官（表面大部分被腹膜覆盖的器官），破裂后腹部X线平片表现为膈下新月形阴影。